腹外疝易发生嵌顿的是
A. 斜疝
B. 直疝
C. 股疝
D. 切口疝
E. 脐疝

正确答案：C。股疝

解析：最容易发生嵌顿的腹外疝是股疝（C对），由于股管几乎是垂直的疝块在卵圆窝处向前转折时形成一锐角，且股环本身较小，周围又多坚韧的韧带，因此股疝容易嵌顿。斜疝（A错）常发生于儿童及青壮年，发生嵌顿性疝机会较多，且临床症状较严重，但并非最常见嵌顿疝。直疝（B错）常见于年老体弱者，平卧后疝块多能自行消失，不需用手推送复位。切口疝（D错）多见于腹部纵行切口，表现为腹壁切口处逐渐膨隆，有肿块出现，一般不发生嵌顿。脐疝（E错）有小儿脐疝和成人脐疝之分，小儿脐疝多属易复性，极少发生嵌顿和绞窄，成人发生嵌顿或绞窄者较多，故应采取手术疗法。